具有非特异性吞噬杀伤和抗原提呈作用的细胞是
A. 中性粒细胞
B. 红细胞
C. NK细胞
D. 巨噬细胞
E. 嗜碱性粒细胞

正确答案：D。巨噬细胞